有关喉返神经的叙述，哪项错误
A. 右侧绕腋动脉
B. 上行于气管食管沟内
C. 左侧绕主动脉弓
D. 与甲状腺下动脉交叉
E. 不能闭眼

正确答案：A。右侧绕腋动脉

解析：右喉返神经在右迷走神经经过右锁骨下动脉前方处发出，由前向后绕过右锁骨下动脉返回向上（A错，为本题正确选项）。左喉返神经在左迷走神经经过主动脉弓前方处发出，并由前向后勾绕主动脉弓返回至颈部（C对）。左、右喉返神经分别行于两侧气管与食管之间的沟内或附近（B对），有甲状腺下动脉与其伴行（D对）。